糖尿病酮症酸中毒时，患者的呼吸气味是
A. 腥臭味
B. 烂苹果味
C. 蒜臭味
D. 酒味
E. 苦杏仁味

正确答案：B。烂苹果味

解析：烂苹果味见于糖尿病酮症酸中毒（B对）。腥臭味见于肝性脑病（A错）。蒜臭味见于有机磷农药、黄磷、铊等中毒（C错）。酒味见于急性乙醇中毒（D错）。氰化物中毒时，呼吸气味有苦杏仁味（E错）。